具有囊内韧带的关节是
A. 肩关节
B. 肘关节
C. 腕关节
D. 髋关节
E. 踝关节

正确答案：D。髋关节

解析：具有囊内韧带的关节是髋关节（D对）和膝关节。髋关节的囊内韧带为股骨头韧带，韧带中有滋养股骨头的动脉；膝关节的囊内韧带为膝关节前、后交叉韧带，主要作用为维持膝关节的稳定性。